由美国国立医药图书馆制作的文献检索工具是
A. 《国际药学文摘》
B. 《生物学文摘》
C. 《医学文摘》
D. 《医学索引》
E. 《医师案头参考》

正确答案：D。《医学索引》

解析：本题考查文献检索工具。《医学索引》（D对）（IM）由美国国立医学图书馆制作。文献检索工具，月刊。《国际药学文摘》（A错）（IPA）由美国医院药师学会编辑出版。收集全世界与药学有关的药学期刊750余种，将文摘按25个主题分类。《生物学文摘》（B错）（BA）由美国生物科学情报服务社编辑出版。覆盖了世界范围生物学领域8000余种核心期刊。《医学文摘》（C错）（EM）荷兰的一个非营利性机构医学文摘基金会创办。收录世界各国5400多种医学、生物学、药学杂志上的文章，编写成文摘，再通过各相关的分册报道。《医师案头参考》（E错）主要介绍美国市场上的常用处方药。